24岁初孕妇。妊娠33周，头痛6天，经检查血压160/110mmHg，治疗3天无显效。今晨5时突然出现剧烈腹痛。检查子宫板状硬。最可能的诊断是
A. 妊娠合并急性阑尾炎
B. 胎盘早剥
C. 前置胎盘
D. 先兆子宫破裂
E. 先兆早产

正确答案：B。胎盘早剥

解析：该孕妇头痛6天（重度子痫前期的脑神经症状），经检查血压160/110mmHg（子痫前期重度：收缩压≥160mmHg和（或）舒张压≥110mmHg），该孕妇是重度子痫前期患者，突然出现剧烈腹痛，检查子宫板状硬，考虑为重度子痫前期并发了Ⅲ度胎盘早剥（B对）。妊娠合并急性阑尾炎（P98）（A错）在妊娠中晚期孕妇多表现为压痛点在右下腹，压痛点位置偏高，压痛反跳痛、肌紧张不明显，但无子宫板状硬等症状。前置胎盘（P127）（C错）典型症状为妊娠晚期或临产时，发生无诱因、无痛性反复阴道流血，与该患者剧烈腹痛、及子宫板状硬不相符。先兆子宫破裂（P218）（D错）常表现为子宫强直收缩引起的剧烈下腹痛，子宫出现病理性的缩腹环，而不是板状硬。先兆流产（P47）（E错）表现为规则或不规则宫缩，伴有宫颈管的进行性缩短，无头痛及子宫板状硬等症状。